可引起驾驶员定向力障碍的药品是
A. 雷尼替丁
B. 人促红素
C. 氨氯地平
D. 多潘立酮
E. 亚油酸

正确答案：A。雷尼替丁

解析：本题考查驾驶员用药。抑酸药雷尼替丁（A对）、西咪替丁、法莫替丁可减少胃酸的分泌，但能引起幻觉、定向力障碍。人促红素（B错）、氨氯地平（C错）、多潘立酮（D错）、亚油酸（E错）均无定向力障碍的不良反应。